在鼓室前壁上有
A. 咽鼓管的开口
B. 乳突窦的入口
C. 鼓室上隐窝
D. 面神经管凸
E. 鼓室盖

正确答案：A。咽鼓管的开口

解析：咽鼓管开口（A对）于鼓室前壁。后壁为乳突壁，上部有乳突窦的入口（B错）。鼓室外侧壁即鼓室上隐窝的外侧壁（C错）。鼓室内侧壁的前庭窗的后上方有一弓形隆起，称面神经管凸，内藏面神经（D错）。上壁又称盖壁（E错）。